属于苯二氮䓬类镇静催眠类药的是
A. 异戊巴比妥
B. 阿米替林
C. 格鲁米特
D. 氯硝西泮
E. 甲丙氨酯

正确答案：D。氯硝西泮

解析：本题考查氯硝西泮。氯硝西泮（D对）为中效苯二氮䓬类镇静催眠药；异戊巴比妥（A错）为巴比妥类镇静催眠药；阿米替林（B错）为三环类抗抑郁药；格鲁米特（C错）为镇静催眠抗惊厥药；甲丙氨酯（E错）常用于治疗精神紧张、失眠。